使肿瘤细胞不能从外界获得其生长所必需的氨基酸的药物是
A. 亚叶酸钙
B. 地塞米松
C. 昂丹司琼
D. 氟它米特
E. L-门冬酰胺酶

正确答案：E。L-门冬酰胺酶

解析：本题考查L-门冬酰胺酶。L-门冬酰胺酶（E对）可将血清中的门冬酰胺水解，导致肿瘤细胞缺乏门冬酰胺供应，阻滞生长，使肿瘤细胞不能从外界获得其生长所必需的L-门冬酰胺。亚叶酸钙（A错）进入体内后，通过四氢叶酸还原酶转变为四氢叶酸，能有效地对抗甲氨蝶呤引起的毒性反应。地塞米松（B错）主要用于消炎。昂丹司琼（C错）主要用于由白细胞毒性药物化疗和放射治疗引起的恶心呕吐。氟它米特（D错）用于抗雄激素，抑制雄激素对前列腺生长的刺激。